络石藤具有的功效是
A. 化湿和胃
B. 凉血消肿
C. 活血止痛
D. 清热解毒
E. 清退虚热

正确答案：B。凉血消肿

解析：该题考查络石藤的功效。络石藤味苦，性微寒，归心、肝、肾经，其功效为祛风通络，凉血消肿（B对）。